局麻药对混合神经产生作用时，首先消失的是
A. 持续性钝痛
B. 短暂性锐痛
C. 冷觉、温觉
D. 触觉、压觉
E. 运动麻痹

正确答案：A。持续性钝痛

解析：局麻药对混合神经产生作用时，首先消失的是持续性钝痛（如压痛），其次是短暂性锐痛，继之依次为冷觉、温觉、触觉、压觉消失，最后发生运动麻痹。掌握“局麻药”知识点。